药品说明书中所列的【有效期】系指该药品被批准的
A. 贮藏期限
B. 使用期限
C. 安全期限
D. 生产日期
E. 销售期限

正确答案：C。安全期限